病人出现反酸症状，并且不能完全缓解，出现有吞咽困难，应选择哪种检查
A. 胃镜
B. CT检查
C. 腹部B超
D. 腹部平片
E. X线检查

正确答案：A。胃镜

解析：病人出现反酸症状（考虑胃、食管疾病），并且不能完全缓解，出现有吞咽困难（符合中晚期食管癌的典型表现），该患者可诊断为食管癌，胃镜是诊断该病的首选方法（A对）；CT检查（B错）可显示肿瘤外侵程度，不作为食管癌的首选检查；腹部B超、腹部平片、X线检查不用来食管癌的检查。